比值比主要应用于
A. 描述研究
B. 生态学研究
C. 病例对照研究
D. 队列研究
E. 流行病学实验研究

正确答案：C。病例对照研究

解析：本题考查比值比的用途。比值比又称比数比、优势比，为病例组与对照组两组暴露比值之比。病例对照研究（C对ABDE错）中没有暴露组和非暴露组的观察人数，不能计算发病率，因此不能直接计算RR，但可用比值比来近似估计RR。